暑淫证候的表现是
A. 头昏沉，嗜睡，胸脘痞闷
B. 口渴饮水，口唇鼻咽干燥
C. 发热恶热，汗出，气短神疲
D. 突发皮肤瘙痒、丘疹、㾦（疒畾）
E. 肠鸣腹泻，脘腹拘急冷痛

正确答案：C。发热恶热，汗出，气短神疲

解析：头昏沉，嗜睡，胸脘痞闷属于湿淫证的表现（A错）。口渴饮水，口唇鼻咽干燥属于燥淫证的表现（B错）。发热恶热，汗出，气短神疲属于暑淫证的表现（C对）。突发皮肤瘙痒、丘疹、㾦（疒畾）属于风淫证的表现（D错）。肠鸣腹泻，脘腹拘急冷痛属于寒淫证的表现（E错）。